在中医学养生中，先天之本是
A. 心
B. 肝
C. 脾
D. 肺
E. 肾

正确答案：E。肾

解析：肾主封藏，内涵元阴元阳，以维持全身阴阳平衡，为先天之本（E对）；心主血脉和主神志（A错）；肝主疏泄和主藏血（B错）；脾主运化和主统血，为后天之本（C错）；肺主气，司呼吸、宣发肃降、通调水道、朝百脉、主治节（D错）。